下列哪项不是提高问卷回收率的方法
A. 争取权威机构的支持，以其名义发放问卷，较易引起重视
B. 版面设计简洁、美观且容易阅读
C. 方便调查对象，注重调查员的培训
D. 注意等级答案的明确性
E. 问卷问题数量合适且容易回答

正确答案：D。注意等级答案的明确性

解析：本题考查口腔健康问卷调查。注意等级答案的明确性（D错，为本题正确答案）不是提高问卷回收率的方法。问卷的科学设计和良好的访谈技巧是获得高回收率的保障。提高回收率的方法有多种，常用的有：①版面设计简洁、美观且容易阅读（B对）；②问卷问题数量合适且容易回答（E对），最好采用打勾、画圈等选择形式；③争取权威机构的支持，以其名义发放问卷，较易引起重视（A对）；④让调查对象事先对研究的目的和意义有所了解，从而更愿意接受调查；⑤方便调查对象；⑥注重调查员的培训（C对）；⑦赠送纪念品以表明调查者要求配合的恳切希望，并表达谢意。